县医疗机构发现该县发生重大食物中毒事件，应在几小时内向所在县级人民政府卫生行政部门报告
A. 1小时
B. 2小时
C. 3小时
D. 4小时
E. 5小时

正确答案：B。2小时

解析：县医疗机构发现该县发生重大食物中毒，属于突发公共卫生事件。根据《突发公共卫生事件应急条例》规定，有下列情形之一的，省、自治区、直辖市人民政府应当在接到报告1小时（A错）内，向国务院卫生行政部门报告；县医疗机构应在2小时（B对）内向所在县级人民政府卫生行政部门报告：发生或者可能发生传染病暴发、流行；发生或者发现不明原因的群体性疾病；发生传染病菌种、毒种丢失；发生或者可能发生重大食物和职业中毒事件。